一电焊学徒工，无防护条件下电焊操作半天后，次日出现眼痛、流泪、怕光。检查见球结膜充血水肿。此患者应诊断为
A. 电光性虹膜炎
B. 电焊工角膜炎
C. 电光性眼炎
D. 视网膜灼伤
E. 急性眼炎

正确答案：C。电光性眼炎